mRNA的5'端“帽子”结构是
A. GPPPmG结构
B. 多聚A结构
C. hnRNA
D. 假尿嘧啶核苷
E. CCA-OH结构

正确答案：A。GPPPmG结构